硫酸阿托品片的含量测定
A. 利用药物的阳离子（BH⁺）与溴甲酚绿阴离子（In⁻）结合成离子对进行测定
B. 样品加冰醋酸10ml和醋酸汞试液4ml后，用高氯酸滴定液滴定
C. 用氯仿提取出药物，加适量醋酐，再用高氯酸滴定液滴定
D. 样品加冰醋酸与醋酐各10ml后，用高氯酸滴定液滴定
E. 样品加水制成每lml约含l6㎍的溶液，在254nm处测定

正确答案：A。利用药物的阳离子（BH⁺）与溴甲酚绿阴离子（In⁻）结合成离子对进行测定